女，20岁。左面颊，面部及眼见巨大葡萄状血管瘤，听诊有吹风样杂音，该患者的最佳治疗方案为
A. 经导管栓塞加手术治疗
B. 左侧颈外动脉结扎
C. 手术治疗
D. 3%鱼肝油酸钠注射
E. 激光治疗

正确答案：A。经导管栓塞加手术治疗

解析：本题考查动静脉畸形的治疗。女，20岁。左面颊，面部及眼见巨大葡萄状血管瘤，听诊有吹风样杂音，该患者的最佳治疗方案为经导管栓塞加手术治疗（A对）。根据左面颊、面部及眼见巨大葡萄状血管瘤，听诊有吹风样杂音，诊断为动静脉畸形，随着介入放射学的发展，经导管动脉栓塞技术被成功用于动静脉畸形的治疗，并成为主要的治疗手段。软组织动静脉畸形一般采用无水乙醇栓塞，弥漫型病变后期可能需要手术切除，以修整外形以及栓塞术后感染的清创，因此最佳治疗方法为经导管栓塞加手术治疗。左侧颈外动脉结扎（B错）不但无效，反而会促进未开放的侧支循环形成，给后期治疗带来困难；手术治疗（C错）后复发率高，对外形和功能破坏大。5%鱼肝油酸钠（D错）、平阳霉素、无水乙醇等的硬化剂注射是静脉畸形治疗的主要治疗手段；激光治疗（E错）用于微静脉畸形和静脉畸形以及手术后的配合治疗。